DNA以半保留复制方式进行复制，一完全被放射性核素标记的DNA分子置于无放射性标记的溶液中复制两代，其放射性状况如何
A. 4个分子的DNA均有放射性
B. 仅2个分子的DNA有放射性
C. 4个分子的DNA均无放射性
D. 4个分子的DNA双链中仅其一条链有放射性
E. 以上都不是

正确答案：B。仅2个分子的DNA有放射性